国家对医疗器械实行分类管理，人工心脏瓣膜在管理分类上属于
A. 第一类
B. 第二类
C. 第三类
D. 第四类
E. 第五类

正确答案：C。第三类

解析：本题考查医疗器械的分类管理。医疗器械划分为三类：第一类为通过常规管理足以保证其安全性、有效性的医疗器械。第二类为对其安全性、有效性应当加以控制的医疗器械。第三类是用于植入人体或支持维持生命，对人体具有潜在危险，对其安全性、有效性必须严格控制的医疗器械。人工心脏瓣膜在管理分类上属于第三类（C对）。